患牙持续性、搏动性剧烈跳痛5天。不注意触碰患牙亦感疼痛难忍。口腔检查：患牙叩诊（+++），松动Ⅲ°，牙龈红肿，移行沟变浅，扪诊深部有波动感。急诊处理最佳方法是
A. 开放髓腔即可
B. 开通髓腔引流通道，穿通根尖孔
C. 开通髓腔引流通道，穿通根尖孔，局麻下切开排脓
D. 安抚治疗
E. 调整咬合

正确答案：C。开通髓腔引流通道，穿通根尖孔，局麻下切开排脓

解析：本题考查应急处理。患牙持续性、搏动性剧烈跳痛5天。不注意触碰患牙亦感疼痛难忍。口腔检查：患牙叩诊（+++），松动Ⅲ°，牙龈红肿，移行沟变浅，扪诊深部有波动感。急诊处理最佳方法是开通髓腔引流通道，穿通根尖孔，局麻下切开排脓（C对）。患牙有持续性、搏动性剧烈跳痛5天，叩诊（+++），松动Ⅲ°，牙龈红肿，移行沟变浅，扪诊深部有波动感，患者的临床表现符合急性根尖周炎至骨膜下脓肿期的病变特点。因骨膜坚韧、致密，脓液集聚于骨膜下所产生的压力很大，病程至此，疼痛达到最高峰，患者感极端痛苦，因此急诊处理首先需要解决的问题就是缓解疼痛，应开通髓腔引流通道，穿通根尖孔，局麻下切开排脓，以缓解根尖部的压力，解除疼痛。因脓液聚积在骨膜下，仅开放髓腔（A错）或仅开通髓腔引流通道，穿通根尖孔（B错），而不切开排脓，则脓液在骨膜下依然得不到引流，无法使疼痛达到缓解。安抚治疗（D错）仅适用于牙髓充血、有轻度炎症的病例，可缓慢作用于牙髓使其炎症消退或减轻，不能有效缓解剧烈疼痛。调整咬合（E错）可使患牙咬合降低、功能减轻，使患牙得以休息，对于外伤引起的急性根尖周炎有明显效果，但对于由脓液积聚引起的疼痛无明显缓解作用。